女，28岁，近4个月来全口牙龈逐渐肿大，刷牙时牙龈易出血，偶有牙龈自动出血史。若患者妊娠6个月，诊断为妊娠期龈炎，临床上最可能表现为
A. 牙龈疼痛、恶臭
B. 牙齿松动整理
C. 牙龈为纤维性增大
D. 牙龈色鲜红、光亮
E. 牙龈坏死

正确答案：D。牙龈色鲜红、光亮

解析：本题考查妊娠期龈炎的临床表现。若患者妊娠6个月，诊断为妊娠期龈炎，临床上最可能表现为牙龈色鲜红、光亮（D对）。妊娠期龈炎是指妇女妊娠期间，由于女性激素水平升高，原来的牙龈慢性炎症加重，使牙龈肿胀或形成龈瘤样的改变，颜色鲜红或暗红色，松软而光亮。急性坏死性溃疡性龈炎常表现为牙龈疼痛、恶臭（A错）、坏死（E错）。妊娠期龈炎为软组织病变，无牙齿松动整理（B错）表现。妊娠期龈炎为炎性血管性肉芽肿，而不是牙龈纤维性增生（C错）。